恒牙中有三个牙根的是
A. 中切牙
B. 侧切牙
C. 尖牙
D. 上颌磨牙
E. 下颌磨牙

正确答案：D。上颌磨牙

解析：切牙和尖牙只有一个牙根(ABC错)，前磨牙一般也只有一个牙根，下颌磨牙有两个牙根(E错)，而上颌磨牙有三个牙根(D对)。